眶下神经阻滞麻醉口内注射时进针方向为
A. 下后内
B. 上后内
C. 下后外
D. 上后外
E. 上后

正确答案：D。上后外

解析：眶下神经阻滞麻醉口内注射法：牵引上唇向前向上，注射针与上颌中线成45°角，于侧切牙根尖相应部位的口腔前庭沟顶刺入，向上后外进针，即可到达眶下孔，但不易进入眶下管。掌握“颌面部常用局麻法及牙拔除的麻醉选择”知识点。